某地连续三年统计肝癌死亡率进行比较，以判断发病趋势下列哪一种计算较合理
A. 各年粗死亡率比较
B. 各年年龄标化死亡率比较
C. 各年性别标化死亡率比较
D. 各年病死率比较

正确答案：B。各年年龄标化死亡率比较

解析：本题考查标化死亡率的用途。对于肝癌而言，年龄是进行研究时的一大混杂因素，不同地区死亡率进行比较时需将死亡率标化，通过标准化去除年龄这一混杂因素的影响，标化后的死亡率称为标化死亡率（B对ACD错）。同理，不同地区间的发病率、患病率等疾病频率的比较，也需要进行率的标化。